属于非二氢吡啶类钙通道阻滞剂的是
A. 硝苯地平
B. 氨氯地平
C. 非洛地平
D. 吲达帕胺
E. 维拉帕米

正确答案：E。维拉帕米

解析：钙通道阻滞剂分为二氢吡啶类和非二氢吡啶类。硝苯地平、氨氯地平、非洛地平、吲达帕胺是二氢吡啶类钙通道阻滞剂（ABCD错），而维拉帕米是苯烷胺类，是非二氢吡啶类钙通道阻滞剂（E对）。